关于细胞毒类药物的用法，正确的是
A. 临床治疗肾病综合征首选
B. 主要用于激素敏感型
C. 配合糖皮质激素用于激素依赖型
D. 单独用于激素依赖型
E. 不能用于激素抵抗型

正确答案：C。配合糖皮质激素用于激素依赖型

解析：临床上主要使用的细胞毒药物有环磷酰胺和盐酸氮芥，这类药物可用于激素依赖型或激素抵抗型的患者，协同激素治疗。若无激素禁忌，一般不作为首选或单独治疗用药（C对）。